在我国法律体系中，《食品安全法》属于
A. 第一层次
B. 第二层次
C. 第三层次
D. 第四层次
E. 第五层次

正确答案：C。第三层次

解析：本题考查《食品安全法》在我国法律体系中的层次。在我国的法律体系中，宪法是最高层次的，《刑法》《民法》和三部诉讼法（即刑事、民事、行政诉讼法）为第二层次，《食品安全法》等专门法属于第三层次（C对ABDE错），即与《食品安全法》有关的 刑事案件，必须以《刑法》为依据；有关的民事纠纷也必须以《民法通则》为依据。